环境污染的基本特征为
A. 低浓度长期作用
B. 对机体危害的复杂性
C. 作用广泛性和途径多样性
D. 污染物的多变性和综合作用
E. 以上都是

正确答案：E。以上都是

解析：本题考查环境污染的基本特征。环境污染的基本特征为：低浓度长期作用；对机体危害的复杂性；作用广泛性和途径多样性；污染物的多变性和综合作用（E对ABCD错）。